女性，25岁，心悸、甲状腺肿大，并伴有轻度呼吸不畅，压迫感，首次妊娠2月余，诊为原发性甲亢，最有效的治疗方法是
A. ¹³¹I治疗
B. 抗甲状腺药物治疗
C. 终止妊娠
D. 甲状腺大部切除
E. 普萘洛尔（心得安）治疗

正确答案：B。抗甲状腺药物治疗

解析：本例患者妊娠2月，心悸、甲状腺肿大，伴有轻度呼吸不畅，应诊断为妊娠期甲状腺功能亢进症，首选抗甲状腺药物治疗（B对）。甲状腺大部切除（D错）可导致早产、流产，麻醉剂亦可致畸，适用于妊娠T2期（4～6个月）经PTU治疗未能控制的甲亢。¹³¹I治疗（A错）具有放射性，可致畸。妊娠期甲亢若能够得到有效控制，对母体及胎儿影响不大，可正常分娩，因此不应选择终止妊娠（C错）。普萘洛尔（心得安）治疗（E错）仅能够控制甲亢临床症状，无法减少甲状腺激素的分泌及缩小甲状腺腺体体积。